女性，30岁，持续发热10天，体温呈稽留热。体检：精神萎糜，反应淡漠，体温39.5℃，心率76次/分，肝肋下1.5cm，脾肋下2cm。WBC1.4×10⁹/L，N0.40，L0.60，肥达氏反应OL：80（+），H1：160（+），ALT180U/L，总胆红素22.2mol/L，HBsAg阴性。为确定诊断应进行检查的项目是
A. 血培养
B. 甲肝病毒抗体
C. 戊肝病毒抗体
D. 丙肝病毒抗体
E. 粪便培养

正确答案：A。血培养

解析：30岁女性患者，持续发热10天，体温呈稽留热（伤寒发热特征），查体精神萎糜，反应淡漠（伤寒面容），体温39.5℃，心率76次/分（相对缓脉），肝肋下1.5cm，脾肋下2cm（肝脾大），WBC1.4×10⁹/L（成人正常参考值4～10×10⁹/L），N0.40（成人正常参考值0.5～0.7），L0.60（正常值0.2～0.4），肥达氏反应O1：80（+），H1：160（+）（肥达反应结果有效），根据患者临床表现和实验室结果，最可能的诊断是伤寒。患者ALT180U/L（正常参考值0～40U/L），总胆红素22.2mol/L（正常参考值3.4～17.1μmol/L），HBsAg阴性（排除乙肝），即有肝损害表现，考虑并发中毒性肝炎，该病例最可能的诊断是伤寒合并中毒性肝炎，持续发热10天说明在病程第1～2周，此时血培养阳性率最高，可达80%～90%，所以为确定诊断应进行检查的项目是血培养（A对）。甲肝病毒抗体（B错）、戊肝病毒抗体（C错）、丙肝病毒抗体（D错）都是肝炎病毒的检查方法，不适用于本例患者。粪便培养（E错）在第二周阳性率才逐渐升高，不用于早期诊断。